中间综合征常发生在有机磷农药中毒后
A. 4～12小时
B. 24～96小时
C. 7～9天
D. 12～24天
E. 2～60天

正确答案：B。24～96小时

解析：有机磷农药中毒临床表现根据其发生时间可分为三类：急性中毒期多发生于吸入毒物后6小时内；迟发性多发神经病多于急性重度和中度OPI中毒患者症状消失后2～3周发生；中间型综合征多发生在重度OPI中毒后24～96小时（B对）。